蜂蜜放久或遇冷析出的白色颗粒状结晶其成分是
A. 碳酸钙
B. 草酸钙
C. 蔗糖
D. 果糖
E. 葡萄糖

正确答案：E。葡萄糖